根据《处方管理办法》，药师对处方用药适宜性的审核内容包括
A. 是否存在重复给药现象
B. 处方用药与临床诊断的相符性
C. 药品剂量、用法的正确性
D. 用剂型与给药途径的合理性
E. 潜在临床意义的药物相互作用和配伍禁忌的可能性

正确答案：A、B、C、D、E。是否存在重复给药现象；处方用药与临床诊断的相符性；药品剂量、用法的正确性；用剂型与给药途径的合理性；潜在临床意义的药物相互作用和配伍禁忌的可能性

解析：本题考察处方管理。药师应当对处方用药适宜性进行审核，审核内容包括：①规定必须做皮试的药品，处方医师是否注明过敏试验及结果的判定；②处方用药与临床诊断的相符性（B对）；③剂量、用法的正确性（C对）；④选用剂型与给药途径的合理性（D对）；⑤是否有重复给药现象（A对）；⑥是否有潜在临床意义的药物相互作用和配伍禁忌（E对）；⑦其他用药不适宜情况。